下列关于含牙囊肿的描述中，正确的是
A. 发生于牙冠或牙根形成之后
B. 可来自一个牙胚，含一个牙
C. 可来自多个牙胚，含多个牙
D. 含牙囊肿就是滤泡囊肿
E. 以上说法均正确

正确答案：E。以上说法均正确

解析：含牙囊肿又称滤泡囊肿。发生于牙冠或牙根形成之后，在缩余釉上皮与牙冠面之间出现液体渗出而形成含牙囊肿。可来自一个牙胚（含一个牙）；也有来自多个牙胚（含多个牙）者。掌握“牙源性颌骨囊肿”知识点。